苦杏仁的主要镇咳有效成分是
A. 苦杏仁苷酶
B. 苦杏仁苷
C. 脂肪油
D. 苯甲醛
E. 苦杏仁酶

正确答案：B。苦杏仁苷

解析：本题考查的是苦杏仁的药理作用。苦杏仁的主要镇咳有效成分是苦杏仁苷（B对）。苦杏仁具有镇咳、平喘、祛痰及增强免疫功能的作用。苦杏仁苷既是苦杏仁止咳祛痰的药效物质基础，又是其毒性产生的主要原因，过量服用有毒。苦杏仁苷是一种氰苷。在合适的温度下苦杏仁酶（E错）发挥作用，使苦杏仁苷迅速酶解。水解所得到的苷元α-羟基苯乙腈很不稳定，易分解生成苯甲醛（D错）和氢氰酸。其中苯甲醛具有特殊的香味。通常将此作为鉴别苦杏仁苷的方法。脂肪油（C错）与脂肪合称为油脂。油脂大多存在于植物的种子中。含油脂类成分的饮片，如苦杏仁、桃仁等，宜低温冷藏，以防走油酸败。苦杏仁苷酶（A错），2022年考试指南未明确说明。